正已烷在体内的分布与器官的
A. 酶活性有关
B. 血流量有关
C. 蛋白质含量有关
D. 脂肪含量有关
E. 微量元素的贮存量有关

正确答案：D。脂肪含量有关